尿沉渣镜检每高倍视野多少个白细胞即视为异常
A. >3个
B. >1个
C. >5个
D. >8个
E. >10个

正确答案：C。>5个

解析：新鲜尿中，白细胞外形完整，无明显退行性变，胞质内颗粒清晰可见，胞核清楚，常分散存在。正常参考值：玻片法平均0-5个/HP（C对）。若有大量白细胞，提示泌尿系感染，如肾盂肾炎，膀胱炎等。